冷藏可延缓食品的变质是由于
A. 酶活性抑制
B. 水分活度降低
C. 湿度降低
D. 氧气含量降低
E. 渗透压提高

正确答案：A。酶活性抑制

解析：本题考查冷藏可延缓食品变质的原因。低温可以降低酶的活性（A对BCDE错）和食品内化学反应的速度，延长微生物繁殖一代所需的时间，因此食品的低温保藏可以防止或减缓食品的变质，在一定的期限内，可较好地保持食品的品质。